欲了解某病在某地区的危害状况，进行现况调查时宜选用
A. 普查
B. 抽样调查
C. 典型病例调查
D. 住院病例调查
E. 个案调查

正确答案：B。抽样调查

解析：本题考查抽样调查的概念。抽样调查（B对ACDE错）是指通过随机抽样的方法，对特定时点、特定范围内人群的一个代表性样本进行调查，通过对样本中的研究对象的调查研究来推论其所在总体的情况。本题中想要调查某地区某病的情况，用普查的方法较为复杂，适合用抽样调查的方式，通过样本来估计总体的情况。